《中国药典》一部规定，测丹皮酚的药材是
A. 甘草
B. 当归
C. 丹参
D. 徐长卿
E. 紫草

正确答案：D。徐长卿

解析：本题考查的是徐长卿的主要成分。《中国药典》一部规定，测丹皮酚的药材是徐长卿（D对）。木类中药大多有树脂及挥发油而有特殊香气，如沉香、檀香、降香等。有的中药具有香气成分，如牡丹皮、徐长卿含丹皮酚，具有特殊香气，香加皮含甲氧基水杨醛也具有特殊香气。甘草（A错）所含的三萜皂苷以甘草皂苷含量最高。《中国药典》以甘草苷和甘草酸为指标成分，控制甘草和炙甘草的质量，其中甘草苷为黄酮苷，并要求甘草和炙甘草的甘草苷含量均不得少于0.50%，甘草中甘草酸的含量不得少于2.0%，炙甘草中甘草酸的含量不得少于1.0%。当归（B错）中主要含有有机酸类成分、挥发油和多糖类成分。有机酸类成分主要包括阿魏酸、香草酸、烟酸和琥珀酸等。《中国药典》以阿魏酸和挥发油为指标成分对当归进行含量测定，要求阿魏酸含量不得少于0.050%，挥发油含量不得少于0.4%（ml/g）。丹参（C错）的化学成分主要包括脂溶性成分和水溶性成分两大部分。脂溶性成分大多为共轭醌、酮类化合物。《中国药典》采用高效液相色谱法测定丹参中丹参酮类和丹酚酸B的含量，要求丹参酮Ⅱ、隐丹参酮和丹参酮Ⅰ的总量不得少于0.25%，丹酚酸B不得少于3.0%。紫草（E错）的主要化学成分为萘醌类化合物，包括乙酰紫草素、欧紫草素、紫草素等。《中国药典》采用紫外分光光度法测定紫草药材中羟基萘醌总含量，以左旋紫草素计，不得少于0.80%。